评价学校口腔健康教育后学生有效刷牙等行为变化的指标是
A. 形成率
B. 检出率
C. 知晓率
D. 正确应答率
E. 因病缺课率

正确答案：B。检出率